对于公共卫生从业人员来说，在慢性非传染病防控中应遵循的伦理要求
A. 积极开展健康教育，促进人们健康行为、生活方式的转变
B. 尊重科学，具有奉献精神
C. 认真做好传染病的监测和报告，履行其道德和法律责任
D. 尊重传染病患者的人格和权利
E. 积极开展传染病的防控，对广大群众的健康负责

正确答案：A。积极开展健康教育，促进人们健康行为、生活方式的转变